肺脾共同化生的气是
A. 精气
B. 营气
C. 卫气
D. 宗气
E. 元气

正确答案：D。宗气

解析：宗气的生成有两个来源：一是脾胃运化的水谷之精所化生的水谷精气，一是肺从自然界中吸入的清气，两者结合生成宗气，故肺脾共同化生的气是宗气（D对）。元气指以先天精气为基础，赖后天精气充养，而根源于肾的气（E错）。营气来源于脾胃运化之水谷精微，由水谷精微中的精华部分，即最富营养的部分所化生（B错）。卫气来源千脾胃运化之水谷精微，由水谷精微中的漂悍部分，即最具活力部分所化生（C错）。